噻嗪类利尿药可引起血清胆固醇增加
A. 1%～5%
B. 5%～10%
C. 5%～15%
D. 10%～15%
E. 10%～20%

正确答案：C。5%～15%

解析：噻嗪类利尿药代谢变化：可导致高血糖、高脂血症。可能是因其抑制了胰岛素的分泌以及减少组织利用葡萄糖。可使血清胆固醇增加5%～15%，并增加低密度脂蛋白。掌握“袢利尿药及噻嗪类”知识点。